庆大霉素C组分检查方法的叙述中，正确的有
A. 用薄层色谱法进行检查
B. 用比色法进行检查
C. 用气相色谱法进行检查
D. 用高效液相色谱法进行检查
E. 用蒸发光散射检测器检查

正确答案：D、E。用高效液相色谱法进行检查；用蒸发光散射检测器检查